经饮水传播的传染病
A. 发病往往有年龄差异
B. 有时可造成爆发流行
C. 两种流行特征都有
D. 两种流行特征都无

正确答案：B。有时可造成爆发流行

解析：本题考查经饮水传播的传染病的流行特征。经饮用水传播所致传染病的流行特征为：病例分布与供水范围一致，有饮用同一水源史，病例饮用同一被污染的水源可造成暴发流行（B对ACD错）。